不属于糖皮质激素类药物抗休克作用机制的是
A. 增强心肌收缩力
B. 抑制炎性细胞因子释放
C. 中和细菌外毒素
D. 扩张痉挛收缩的血管
E. 稳定溶酶体膜

正确答案：C。中和细菌外毒素

解析：糖皮质激素常用于严重休克，特别是感染中毒性休克的治疗。糖皮质激素可以抑制炎症因子的释放（B对），减轻全身炎症反应综合征及组织损伤，使微循环血流动力学恢复正常，改善休克状态，可以稳定溶酶体膜（E对），减少心肌抑制因子的形成，扩张痉挛收缩的血管（D对）和兴奋心脏、加强心肌收缩力（A对），提高机体对细菌内毒素的耐受力，但对细菌外毒素没有防御作用（C错，为本题正确答案）。